对于腮腺区肿物不宜进行的检查是
A. 细针吸取细胞学检查
B. CT或MRI
C. 涎腺造影
D. 切取活检术
E. B超

正确答案：D。切取活检术

解析：本题考查唾液腺肿瘤的诊断。对于腮腺区肿物不宜进行的检查是切取活检术（D错，为本题的正确答案）。腮腺区的肿瘤无论良、恶性，切取活组织检查均有发生瘤细胞种植的危险，故腮腺区的肿瘤不宜做切取活检术。临床上不易确定肿块是否为肿瘤，细针吸取细胞学检查（A对）常可结合临床做出明确诊断，从而避免不必要的手术。CT检查对肿瘤的定位十分有益，可确定肿瘤的部位以及与周围组织，包括重要血管之间的关系，特别适用于腮腺深叶肿瘤。MRI对于软组织的分辨率高于CT（B对），肿瘤与血管的关系也能很好显示。唾液腺造影（C对）对于唾液腺炎症及舍格伦综合症的诊断价值很高。B超（E对）可以判断有无占位性病变以及肿瘤的大小，并估计大致的性质，当临床上腮腺良性肿大、腮腺或下颌下腺炎症肿块等与肿瘤难以区分时，可首选B超检查。